关于子痫，下述哪项不对
A. 大多数子痫病人抽搐前有头痛，胸闷，视力障碍及呕吐等前驱症状
B. 子痫的发生以产前期为最多见
C. 抽搐频繁，昏迷不醒大多病情严重
D. 终止妊娠是治疗子痫最根本方法，一旦分娩后子痫就不再发生
E. 子痫发作时易致自伤及胎儿窘迫

正确答案：D。终止妊娠是治疗子痫最根本方法，一旦分娩后子痫就不再发生

解析：子痫是妊娠期高压疾病最严重的阶段，是妊娠期高血压疾病所致母儿死亡的最主要原因，应积极处理，子痫处理原则为控制抽搐，纠正缺氧和酸中毒，控制血压，抽搐控制后终止妊娠。子痫多发生于妊娠晚期或临产前，称产前子痫；少数发生于分娩过程中，称产时子痫；个别发生于产后24小时内，称产后子痫。所以D项的描述不正确。掌握“娠期高血压疾病”知识点。